抗凝血类杀鼠剂的中毒机制是
A. 拮抗γ-氨基丁酸（GABA）
B. 中断三羧酸循环和妨碍正常的氧化磷酸化过程
C. 干扰肝脏对维生素K的作用，致凝血时间与凝血酶原时间延长
D. 抑制胆碱酯酶
E. 与血红蛋白结合，形成碳氧血红蛋白，阻碍氧的释放和传递

正确答案：C。干扰肝脏对维生素K的作用，致凝血时间与凝血酶原时间延长